下列哪项不属于滑脉的主病
A. 痰饮
B. 食滞
C. 实热
D. 疟疾
E. 恶阻

正确答案：D。疟疾

解析：若机体感受疟邪，滞留于半表半里，少阳枢机不利，可见弦脉，正如《金匮要略》所说“疟脉自弦”（D错，为本题正确答案）。滑脉是指往来流利，应指圆滑，如盘走珠的脉象。痰湿留聚（A对），食积饮停（B对），都是阴邪内盛，有形实邪积聚于内，气血涌实，所以脉见圆滑流利。实热（C对）入于血分，血行加速，则脉来亦滑，且为滑数。妊娠恶阻（E对），可见滑脉。